用于定性的参数是
A. 色谱峰高或峰面积
B. 死时间
C. 色谱峰保留时间
D. 色谱峰宽
E. 色谱基线

正确答案：C。色谱峰保留时间

解析：本题考查色谱法。用于定性的参数是色谱峰保留时间（C对）。保留时间定义为被分离组分从进样到柱后出现该组分最大响应值时的时间，也即从进样到出现某组分色谱峰的顶点时为止所经历的时间，常以分钟（min）为时间单位,用于反映被分离的组分在性质上的差异。峰高为组分色谱峰顶点至时间轴的垂直距离；峰面积为组分色谱峰与基线围成的区域的面积，两者（A错）可用于定量参数。死时间（B错）为不保留组分（不溶于固定相或不被固定相所吸附）的保留时间。色谱峰宽（D错）为通过色谱峰两侧的拐点作切线，在基线上的截距，用于衡量柱效。基线（E错）为在操作条件下，没有组分流出时的流出曲线，基线反映仪器噪音随时间的变化。